某男，40岁。诊断为病毒性心肌炎，证属气阴两虚，予以参麦注射液50ml+氯化钠注射液500ml静脉滴注，一日1次。执业药师审核此处方，应指出的问题是
A. 药物选择不合理
B. 溶媒用量不合理
C. 给药剂量不合理
D. 溶媒选择不合理
E. 给药途径不合理

正确答案：D。溶媒选择不合理

解析：本题考查中药注射剂不合理使用例举。执业药师审核此处方，应指出的问题是溶媒选择不合理（D对）。溶媒选用不当：某女，57岁。冠心病。予以参麦注射液50ml+氯化钠注射液500ml静脉滴注。5分钟后。突感头昏、胸闷、多汗、心悸，继而出现呼吸困难、口唇及肢端发绀、四肢厥冷，面色苍白，血压测不到。立刻停止输液，吸氧，给予肾上腺素注射液12mg、地塞米松注射液10mg静脉推注，15分钟后患者恢复正常。分析：参麦注射液说明书对溶媒的使用有明确规定：“静脉滴注，一次20～100ml（用5%葡萄糖注射液250～500ml稀释后应用）”。该例使用了氯化钠注射液作为溶媒稀释药物。药物选择不合理（A错）：某女，46岁。头晕、心悸、胸闷1年余，加重3天，住院治疗。心电图：Ⅱ、Ⅲ、aVF导联ST段压低1.5mV，T波倒置。血脂提示高胆固醇血症。临床诊断：冠心病。治疗：生脉注射液50ml加入5%葡萄糖注射液300ml静脉滴注，每日1次。3天后病人诉头晕、胸闷加重，口苦纳差，复查心电图结果同前。查体：病人形体肥胖，面色红润，声音洪亮，说话急促。舌质淡暗，苔黄腻，舌根部苔尤厚，脉滑。停用生脉注射液，改瓜蒌薤白汤每日1剂。另予复方丹参注射液20ml加入5%葡萄糖注射液300ml静脉滴注。2天后口苦、头晕、胸闷稍减，胃纳有增。14天后症状完全消失，黄腻苔化，脉细兼滑，心电图恢复正常。分析：生脉注射液由人参、麦冬、五味子组成，具有兴奋心肌β受体，促进心肌收缩，增强心肌对缺氧的耐受性及提高免疫力等药理作用，有升血压、抗休克、改善心肌缺血等作用，临床多用于治疗冠心病、休克等。生脉注射液益气养阴、敛汗生津，用于中医辨证属气阴两虚者，挟痰湿者不宜用。本案证属痰浊蒙蔽兼有瘀血之胸痹，用该药则助湿生痰，更碍气机流畅而致症状加重。溶媒用量不合理（B错）：某男，48岁。原发性肝癌。予以艾迪注射液100ml+5%葡萄糖注射液250ml静脉滴注。用药10分钟，心悸。查体：面色潮红、肿胀，可见散在皮疹，心率70次/分，血压110/70mmHg。立即停止输液，给予苯海拉明注射液20mg肌内注射，30分钟后症状缓解。分析：艾迪注射液说明书[用法用量]注明“成人一次50～100ml，加入0.9%氯化钠注射液或5%～10%葡萄糖注射液400～450ml中静脉滴注。”该例以5%葡萄糖注射液250ml配制溶剂稀释100ml艾迪注射液，溶媒用量明显不足，造成药物浓度过高。给药剂量不合理（C错）：某男，63岁。患高血压、糖尿病、冠心病多年。近因“左膝骨关节炎，右人工膝关节置换术后，左跟骨慢性骨髓炎，左足趾皮肤破溃”入院。患者右膝疼痛，无屈伸不利，左膝关节疼痛，活动受限，时有关节活动弹响声，左足第2足趾破溃，伴少量分泌物，稍红肿疼痛，纳可，寐欠安，二便尚可。舌淡，苔薄白，脉沉细无力。中医诊断为膝痹病，证属肝肾亏虚证。予以氯化钠注射液250ml+注射用丹参多酚酸盐400mg静脉滴注，每日1次。分析：根据注射用丹参多酚酸盐的药品说明书，其单次用量为200mg，医嘱用量过大。给药途径不合理（E错）：某女，50岁。因腰痛给予野木瓜注射液4ml作腰椎束旁痛点封闭注射。突然出现胸闷、心悸、全身麻木，颈、胸部出现皮疹，即予吸氧，皮下注射地塞米松注射液、肾上腺素注射液，静脉滴注葡萄糖酸钙注射液、碳酸氢钠注射液等，对症处理后症状缓解。分析：野木瓜注射液说明书注明给药途径和方式为“肌内注射”，该例用于腰椎束旁痛点封闭注射，从而造成不良反应。